女，48岁，习惯性便秘多年，近日感左少腹作痛，按之累累有硬块，舌淡红，苔薄黄，脉沉缓多为
A. 肠痈
B. 痛经
C. 瘕聚
D. 虫积
E. 宿粪

正确答案：E。宿粪

解析：患者便秘多年，近日左少腹作痛，按之累累有硬块者，多为肠中宿便（E对）。肠痈多见右少腹剧痛而拒按，弹痛（反跳痛）或按之有包块者（A错）。痛经是指在行经期间，或行经前后，阵发性出现下腹部疼痛，或痛引腰骶，甚至剧痛难忍，并伴随月经呈周期性发作的症状（B错）。若腹部有肿块，肿块推之可移，或痛无定处，聚散不定者，为瘕聚（C错）。虫积常见若腹中结块，按之起伏聚散，往来不定，或按之形如条索状，久按转移不定，或按之手下如蚯蚓蠕动者（D错）。